下列主虚证的脉象是
A. 促脉
B. 滑脉
C. 动脉
D. 结脉
E. 代脉

正确答案：E。代脉

解析：脏气衰微，元气不足，鼓动乏力，以致脉气不相接续，故脉来时有歇止，良久复还，脉虚无力，出现代脉（E对）。促脉多见于阳盛实热、气血痰食停滞；亦见于脏气衰败（A错）。滑脉多见于痰湿、食积和实热等病（B错）。动脉常见于惊恐、疼痛（C错）。结脉多见于阴盛气结、寒痰血瘀（D错）。